百部的功效是
A. 消肿生肌
B. 破血止痛
C. 杀虫灭虱
D. 清热收敛
E. 泻水逐饮

正确答案：C。杀虫灭虱

解析：本题考查的是百部的功效。百部的功效是杀虫灭虱（C对）。百部：【功效】润肺止咳，杀虫灭虱。乳香：【功效】活血止痛，消肿生肌（A错）。姜黄：【功效】破血行气，通经止痛（B错）。石膏：【功效】生用：清热泻火，除烦止渴；煅用：收湿敛疮（D错），生肌止血。芫花：【功效】泻水逐饮（E错），祛痰止咳。外用杀虫疗疮。